51岁妇女，绝经3年，阴道流血3个月，TBS分类为高度鳞状上皮细胞内瘤变，进一步处理
A. 切除子宫
B. 子宫次广泛切除
C. 阴道镜检查
D. 宫颈活体组织检查
E. 宫颈锥形切除术

正确答案：D。宫颈活体组织检查

解析：患者为中老年妇女，绝经后出现阴道流血，TBS（阴道细胞学）分类为高度鳞状上皮细胞内瘤变，为明确诊断，进一步处理为行宫颈活体组织检查（D对）。根据病理结果确定分期，制定治疗方案。切除子宫（P304）（A错）适用于经子宫颈锥切确诊、年龄较大、无生育要求、合并有其他手术指征的妇科良性疾病的CINⅢ。子宫次广泛切除（B错）适用于宫颈检查正常，并要求保留宫颈的子宫肌瘤、子宫功能性出血、子宫腺肌瘤患者。阴道镜检查（P443）（C错）将子宫颈或生殖器表皮组织进行光学放大，观察子宫颈上皮及血管的变化，结合活检，以提高宫颈疾病确诊率。宫颈锥形切除术（P307）（E错）适用于子宫颈细胞学检查多次阳性而子宫颈活检阴性者，或子宫颈活检为CINⅡ和CINⅢ需确诊者，或可疑微小浸润癌需了解病灶的浸润深度和宽度等情况。